患者，女，50岁。每年持续咳嗽约5个月，已连续10年，胸部X片示两肺纹理增粗、紊乱。近日来咳嗽加剧，气促，痰多色黄黏稠，面红咽干，渴喜冷饮，便秘，尿赤，舌苔黄腻，脉滑数。应首先考虑的诊断是
A. 急性气管炎风寒犯肺证
B. 慢性气管炎寒饮伏肺证
C. 慢性气管炎痰热郁肺证
D. 急性气管炎痰湿阻肺证
E. 急性气管炎风热犯肺证

正确答案：C。慢性气管炎痰热郁肺证

解析：痰热郁阻肺气，肺失清肃，故见咳嗽加剧，气促，痰多色黄黏稠；肺热内郁故有面红咽干，渴喜冷饮，便秘，尿赤；舌苔黄腻，脉滑数均为痰热郁肺证的表现，可诊断为慢性气管炎痰热郁肺证（C对）。患者每年持续咳嗽5个月，已连续10年，故为慢性支气管炎急性发作（A错）（D错）（E错），寒饮伏肺证（B错）的特点为咳嗽，喘逆不得卧，咳吐清晰白沫痰，量多，与冷空气刺激加重，甚至面浮肢肿，兼恶寒肢冷，微热，小便不利，舌苔白滑，或白腻，脉弦紧，治法为温肺化饮，散寒止咳，方药选用小青龙汤加减。